女，30岁。腹痛、腹泻伴里急后重3天。最初为稀便，2天后为黏液脓血便，偶见片状灰白色膜
A. 纤维素性炎
B. 变质性炎
C. 出血性炎
D. 浆液性炎
E. 化脓性炎

正确答案：A。纤维素性炎

解析：患者青年女性，腹痛、腹泻伴里急后重3天（菌痢的主要临床表现）。最初为稀便，2天后为黏液脓血便，偶见片状灰白色膜（很可能是假膜性炎），最可能诊断为细菌性痢疾，为纤维素性炎（A对）。变质性炎（B错）实质细胞呈明显的变性和坏死，见于乙肝，乙脑。出血性炎（C错）因炎症灶的血管损伤严重，致使渗出物中含大量红细胞，见于鼠疫，流行性出血热和钩端螺旋体病。浆液性炎（D错）常发生于粘膜，浆膜，滑膜，皮肤和疏松结缔组织等，不会形成假膜。化脓性炎（E错）分为表面化脓和积脓，蜂窝织炎和脓肿，不会出现假膜。